HIV在复制过程中可发生较高频率的突变，导致
A. 免疫缺陷
B. 免疫丧失
C. 免疫攻击
D. 免疫识别障碍
E. 抗原性不断发生变化而逃避免疫细胞的识别和攻击

正确答案：E。抗原性不断发生变化而逃避免疫细胞的识别和攻击

解析：病原体机制：许多病毒如流感病毒、HIV在复制过程中可发生较高频率的突变，导致其抗原性不断发生变化而逃避免疫细胞的识别和攻击。掌握“抗感染免疫”知识点。